下列胃癌的组织学分型属于特殊类型的是
A. 乳头状腺癌
B. 管状腺癌
C. 低分化腺癌
D. 未分化癌
E. 印戒细胞癌

正确答案：D。未分化癌